女，52岁。半年前发现右乳腺肿物，发现时大小约2cmx1.5cm，无疼痛，质硬，活动度小。近来肿块扩展至乳房大部，整个乳房增大、红肿、充血、水肿、发热、质硬。如果想确定疾病性质，最可靠的方法是
A. B超
B. 钼靶X线检查
C. 针吸细胞学
D. 粗针活组织检查
E. 磁共振

正确答案：D。粗针活组织检查